预防子宫破裂不包括
A. 做好产前检查
B. 密切观察产程进展
C. 严格掌握宫缩剂使用的适应证、禁忌证
D. 应用镇静剂
E. 手法应轻柔，忌用暴力

正确答案：D。应用镇静剂

解析：预防子宫破裂应做好产前检查（A对），及时发现胎位、骨盆、胎儿的异常，密切观察产程进展（B对），临产后注意宫缩情况及胎先露下降情况，掌握试产的适应证，特别对有剖宫产史准备试产时尤应注意产程进展情况，严格掌握宫缩剂使用的适应证、禁忌证（C对），应用缩宫素催产时需专人监护，规范手术操作，手法应轻柔，忌粗暴（E对）。不包括应用镇静剂（D错，为本题正确答案）。